患者，女，25岁。产后乳房肿块疼痛，排乳不畅，皮色正常，局部发热，压痛，无应指感，伴发热恶寒。内治应首选
A. 瓜蒌牛蒡汤
B. 牛蒡解肌汤
C. 黄连解毒汤
D. 柴胡清肝汤
E. 五味消毒饮

正确答案：A。瓜蒌牛蒡汤

解析：瓜蒌牛蒡汤主治乳房结块肿痛，伴有恶寒发热等证。患者产后乳房肿块疼痛，排乳不畅，皮色正常，局部发热，压痛，无应指感，伴发热恶寒是乳痈初起的表现，治宜疏肝清热，通乳消肿为主故用瓜蒌牛蒡汤功效为清热疏肝，通乳散结（A对）。牛蒡解肌汤（B错）具有解肌清热，化痰消肿之功效。主治头面风热，或颊项痰毒，风热牙痛等。黄连解毒汤（C错）的功用为泻火解毒。主治：三焦火毒热盛证。柴胡清肝汤（D错）的功用为养血清火，疏肝散结。主治：血虚火动，肝气郁结，致患鬓疽，初起尚未成脓者，毋论阴阳表里，俱可服之。五味消毒饮（E错）主治：火热结聚之疔疮。